膈叙述错误的是
A. 有三个孔、裂
B. 中央部为腱性结构
C. 食管裂孔内有迷走神经通过
D. 主动脉裂孔内有胸导管通过
E. 收缩时膈穹上升助呼气

正确答案：E。收缩时膈穹上升助呼气

解析：膈中央部为腱性结构（B对），有三个孔、裂（A对），其中，食管裂孔内有迷走神经通过（C对），主动脉裂孔内有胸导管通过（D对），收缩时膈穹下降助吸气，而非上升助呼气（E错，为本题正确答案）。